中毒性白内障是下列哪种毒物中毒最常见的特征性体征
A. 三硝基甲苯
B. 砷
C. 镉
D. 汞
E. 铅

正确答案：A。三硝基甲苯